女，59岁。右上腹剧痛15天，伴发热10天。乙肝病史10年，慢性支气管炎病史8年。查体：T38.3℃，慢性病容，颈静脉无怒张，双肺呼吸音减弱，未闻及湿啰音，腹膨隆，肝右肋下4cm，双下肢凹陷性水肿。肝功能检查正常。下列检查对明确诊断意义不大的是
A. 血清AFP
B. 腹部CT
C. 腹部B型超声
D. 血乙肝病毒DNA
E. 肝穿刺活检

正确答案：D。血乙肝病毒DNA

解析：血乙肝病毒DNA（D错，为本题正确答案）不能用于明确诊断肝癌，但能确诊乙肝。血清AFP（A对）≥400μg/L，可用于鉴别诊断肝癌。腹部CT（B对）、腹部B型超声（C对）可显示肿瘤部位、数目、大小、形态等。肝穿刺活检（E对）可用于明确诊断肝脓肿和肝癌。